用同一问卷在不同时间对同一研究对象进行重复测量，所得结果一致性的程度，是
A. 复测信度
B. 复本信度
C. 准则效度
D. 内容效度
E. 折半信度

正确答案：A。复测信度